腹股沟深淋巴结沿下列哪些结构排列
A. 大隐静脉末端
B. 股静脉
C. 腹股沟韧带
D. 股深静脉
E. 股动脉

正确答案：B。股静脉

解析：腹股沟深淋巴结沿股静脉（B对）排列，位于股静脉周围和股管内。